糖尿病发病率近15年来持续上升
A. 短期波动
B. 季节性
C. 周期性
D. 长期趋势
E. 变化浮动

正确答案：D。长期趋势

解析：长期趋势即长期变异，是指经过一个相当长的时期（通常为几年或几十年），疾病的分布状态、感染类型、临床表现等逐渐发生显著的趋势性变化。题干中描述糖尿病在近15年的发病率变化，所以是长期趋势（D对）。